在糖尿病的筛查试验中，甲方案将血糖阳性标准定在110mg/100ml，乙方案将血糖阳性标准定在130mg/100ml，这意味着
A. 甲方案的灵敏度比乙方案的高
B. 甲方案的灵敏度比乙方案的低
C. 甲方案的灵敏度与乙方案的相等
D. 两种方案的灵敏度均增高
E. 两种方案的灵敏度均降低

正确答案：A。甲方案的灵敏度比乙方案的高

解析：本题考查灵敏度的概念。灵敏度，又称真阳性率，即实际患病且被筛检试验标准判断为阳性的百分比，反映了筛检试验发现病人的能力。甲方案设定的标准更低，更容易将病人从人群中筛选出来，因此甲方案的灵敏度比乙方案高（A对BCDE错）。